下列哪一选项不是预防尘肺的技术措施
A. 改革工艺
B. 湿化作业
C. 通风
D. 戴防尘口罩

正确答案：D。戴防尘口罩

解析：本题考查综合防尘降尘措施。简称为八字方针，革、水、密、风、护、管、教、查。1.革，要求改革生产工艺（A对）和革新生产设备，是消除粉尘危害的根本途径；2.水，即湿式作业（B对），增大空气湿度，可降低环境粉尘浓度；3.密，密闭尘源；4.风，加强通风（C对）及抽风除尘；5.护，做好个人防护；6.管，经常性地维修和管理工作；7.教，加强宣传教育；8.查，定期检查环境空气中粉尘浓度，保证接触者的定期体格检查。D选项中，防尘口罩的佩戴属于个体的防护措施，并不是技术措施（D错，为本题正确答案）。